对蒽醌类衍生物酸性影响最大的基团是
A. 羰基
B. 蒽环
C. β-羟基
D. 羧基
E. a-羟基

正确答案：D。羧基

解析：本题考查的是蒽醌类衍生物的酸碱性。对蒽醌类衍生物酸性影响最大的基团是羧基（D对）。蒽醌类衍生物的酸性的强弱排列顺序为：含-COOH＞含两个以上β-OH（C错）＞含一个β-OH＞含两个以上α-OH（E错）＞含一个α-OH。